IP₃受体位于
A. 质膜
B. 高尔基体
C. 内质网
D. 溶酶体
E. 核糖体

正确答案：C。内质网